止于肱骨小结节的肌有
A. 冈上肌
B. 冈下肌
C. 三角肌
D. 小圆肌
E. 肩胛下肌

正确答案：E。肩胛下肌

解析：冈上肌（A错）、冈下肌（B错）、小圆肌（D错）止于肱骨大结节。三角肌（C错）止于肱骨三角肌粗隆。肩胛下肌（E对）止于肱骨小结节。